黏性差的矿物药制蜜丸应选用
A. 老蜜
B. 蜜水
C. 中蜜
D. 蜂蜜
E. 嫩蜜

正确答案：A。老蜜

解析：本题考查的是蜜丸的赋形剂。黏性差的矿物药制蜜丸应选用老蜜（A对）。根据炼制程度，炼蜜有嫩蜜、中蜜（炼蜜）、老蜜三种规格，适合于不同性质的药粉制丸。①嫩蜜（E错）：炼制温度在105℃～115℃，含水量为17%～20%，相对密度约1.35，色泽无明显变化，稍有黏性。适合于含较多黏液质、胶质、糖、淀粉、油脂、动物组织等黏性较强的药粉制丸。②中蜜（C错）（又称炼蜜）：炼制温度达116℃～118℃，含水量在14%～16%，相对密度为1.37左右，炼制时表面翻腾“鱼眼泡”（黄色均匀而有光泽的气泡）。手指捻有黏性，但两指分开指间无长白丝出现。适用于黏性中等的药粉制丸，为大部分蜜丸所采用。③老蜜：炼制温度达119℃～122℃，含水量在10%以下，相对密度约为1.40，呈红棕色。炼制时表面出现“牛眼泡”（较大的红棕色气泡），能“滴水成珠”（滴入冷水呈球形而不散）。手指捻黏性强，两指分开时，有白色长丝（俗称“打白丝”）。适用于黏性差的矿物药或富含纤维的药粉制丸。